关于听觉中枢的的描述，错误的是
A. 接受内侧膝状体的纤维
B. 位于颞横回
C. 一侧损伤将导致伤侧全聋
D. 一侧损伤将导致伤侧听力减弱
E. 接受听辐射的纤维

正确答案：C。一侧损伤将导致伤侧全聋

解析：听觉中枢位于颞横回（B对），接受内侧膝状体（A对）组成的听辐射（E对）纤维。因每侧听觉中枢都接受来自两耳的冲动，故一侧听觉中枢损伤将导致伤侧听力减弱（D对），但不会导致伤侧全聋（C错，为本题正确答案）。